固位力包括基托与黏膜间的唾液薄膜层的
A. 摩擦力
B. 吸附力
C. 表面张力
D. 大气压力
E. 重力

正确答案：C。表面张力

解析：表面张力：基托与黏膜间的唾液薄膜层的表面张力。掌握“局部义齿人工牙及基托”知识点。